女性患者，甲状腺肿大伴多汗、多食、消瘦、心悸、烦躁，根据同位素扫面及血T₃、T₄检查，诊断为甲亢。治疗期间应定期复查
A. 尿常规
B. 肝肾功能
C. 血常规
D. 心电图
E. 甲状腺扫描

正确答案：C。血常规

解析：本题考查甲亢治疗期间的定期检查。女性患者，甲状腺肿大伴多汗、多食、消瘦、心悸、烦躁，根据同位素扫面及血T₃、T₄检查，诊断为甲亢。治疗期间应定期复查血常规（C对），以监测外周血白细胞数目，当发生粒细胞缺乏症的时候应及时停药。尿常规（A错）主要用于泌尿系疾病的协助诊断。肝肾功能（B错）用于检测用药后所引起的肝肾功能损害，常用于丙硫氧嘧啶，因可引起药物性肝炎。心电图（D错）主要用于诊断甲亢性心脏病所引起的心律失常。甲状腺扫描（E错）可用来协助诊断甲状腺结节的性质，对诊断甲状腺自主高功能腺瘤有意义。